导致心脏性猝死最常见的原因是
A. 心脏瓣膜病
B. 冠状动脉粥样硬化性心脏病
C. 扩张型心肌病
D. 慢性肺源性心脏病
E. 急性心肌炎

正确答案：B。冠状动脉粥样硬化性心脏病

解析：心脏性猝死最常见的原因是冠状动脉粥样硬化心脏病（B对），而心肌病（C错）是冠心病易患年龄前（＜35岁）心脏性猝死的主要原因，心脏瓣膜病（A错）、慢性心源性心脏病（D错）和急性心肌炎（E错）也可导致心脏性猝死，但都并非最常见的原因。